横断面类白色或浅灰黄色，形成层环纹呈多角形的药材是
A. 白及
B. 白芍
C. 川牛膝
D. 川乌
E. 白附子

正确答案：D。川乌

解析：本题考查的是川乌药材的性状鉴别。横断面类白色或浅灰黄色，形成层环纹呈多角形的药材是川乌（D对）。川乌：【性状鉴别】药材呈不规则圆锥形，稍弯曲，顶端常有残茎，中部多向一侧膨大。表面棕褐色或灰棕色，皱缩，有小瘤状侧根及子根脱离后的痕迹。质坚实。断面类白色或浅灰黄色，形成层环纹呈多角形。气微，味辛辣、麻舌。白及（A错）：【性状鉴别】药材呈不规则扁圆形，多有爪状分枝。表面灰白色至灰棕色，或黄白色，有数圈同心环节和棕色点状须根痕，上面有突起的茎痕，下面有连接另一块茎的痕迹。质坚硬，不易折断，切面类白色，角质样。气微，味苦，嚼之有黏性。白芍（B错）：【性状鉴别】药材呈圆柱形，平直或稍弯曲，两端平截。表面类白色或淡红棕色，光洁或有纵皱纹及细根痕，偶有残存的棕褐色外皮。质坚实，不易折断，断面较平坦，类白色或略带棕红色，形成层环明显，射线放射状。气微，味微苦、酸。川牛膝（C错）：【性状鉴别】药材呈近圆柱形，微扭曲，向下略细或有少数分枝。表面黄棕色或灰褐色，具纵皱纹、支根痕和多数横长的皮孔样突起。质韧，不易折断，断面浅黄色或棕黄色，异型维管束点状，排列成数轮同心环。气微，味甜。白附子（E错）药材的性状鉴别，2022年考试指南未明确说明。白附子：【性状鉴别】药材呈椭圆形或卵圆形。表面白色至黄白色，略粗糙，有环纹及须根痕，顶端有茎痕或芽痕。质坚硬，断面白色，粉性。气微，味淡、麻辣刺舌。